上皮细胞没有细胞间桥，细胞肿胀呈圆形，核染色深，常有胞质晕环绕着核周围，这种游离为单个或数个成团的细胞，称为
A. Civatte小体
B. 肖曼小体
C. 天疱疮细胞
D. 狼疮带
E. 基层下疱

正确答案：C。天疱疮细胞

解析：天疱疮的病理特征为棘层松解和上皮内疱形成。由于疱壁薄且脆弱易破，以及有周缘扩展现象，很难切取到完整的疱，但镜下仍然见到松解的棘细胞，这种上皮细胞没有细胞间桥，细胞肿胀呈圆形，核染色深，常有胞质晕环绕着核周围，这种游离为单个或数个成团的细胞，称为天疱疮细胞（又称Tzanck细胞）。掌握“口腔黏膜下纤维化与天疱疮，类天疱疮”知识点。